缩写HPLC是指
A. 气相色谱法
B. 高效液相色谱法
C. 十八烷基硅烷键合硅胶
D. 红外分光光度法
E. 差示扫描量热法

正确答案：B。高效液相色谱法

解析：本题考查色谱法。缩写HPLC是指高效液相色谱法（B对）。高效液相色谱法（HPLC法）系采用高压输液泵将规定的流动相泵入装有填充剂的色谱柱，对已注入色谱柱的供试品进行分离测定的色谱方法。气相色谱法（A错）的缩写为GC；十八烷基硅烷键合硅胶（C错）的缩写为ODS；红外分光光度法（D错）的缩写为IR；差示扫描量热法（E错）的缩写为DSC。